关系表现在血液生成和血液运行方面的两脏是
A. 肝与脾
B. 脾与肾
C. 心与肝
D. 心与脾
E. 心与肺

正确答案：D。心与脾

解析：脾主运化而为气血生化之源，水谷精微经脾转输至心肺，贯注于心脉而化赤为血，血液在脉中正常运行，赖于心气的推动，因此表现在血液生成和血液运行方面的两脏是心与脾（D对）；肝与脾的关系，主要表现在疏泄与运化的相互为用、藏血与统血的相互协调关系（A错）；脾与肾的关系，主要表现在先天后天相互资生与津液代谢方面（B错）；心与肝的关系，主要表现在行血与藏血以及精神情志调节两个方面（C错）；心与肺的关系，主要表现在心主血与肺主气、心主行血与肺主呼吸之间的关系（E错）。